复位后需要屈腕尺偏固定的是
A. 桡骨小头半脱位
B. 孟氏骨折
C. 盖氏骨折
D. colles 骨折
E. 桡骨干骨折

正确答案：D。colles 骨折

解析：桡骨小头半脱位（A错）不用麻醉可直接手法复位，复位后不用固定，但不可再次暴力牵拉，以免复发。孟氏骨折（B错）为尺骨上1/3骨干骨折合并桡骨小头脱位，大多数病人可用手法复位外固定治疗，先复位桡骨，恢复前臂长度，随着桡骨头的复位，可撑开重叠的尺骨，使尺骨复位较易成功。盖氏骨折（C错）为桡骨干下1/3骨折合并尺骨小头脱位，首先采用手法复位、石膏固定。colles骨折（D对）为桡骨远端骨折的一种类型，X线片示骨折远端向桡、背侧移位，近段向掌侧移位，复位后需在屈腕、尺偏位检查骨折对位对线情况及稳定情况再固定。。